患者素有水饮，复感风寒，恶寒发热，无汗，咳喘痰多而稀，身体重痛，舌苔白滑，脉浮。治疗应选用
A. 苓桂术甘汤
B. 五苓散
C. 小青龙汤
D. 苏子降气汤
E. 麻黄汤

正确答案：C。小青龙汤

解析：患者脏腑功能失调，卫外不固，外感六淫之邪更易侵袭肺卫，导致宣降失和，肺气不利，引动伏痰，则易发生咳嗽痰多而稀等症。患者为外有风寒，内有水饮，治疗可用小青龙汤（C对）。苓桂术甘汤用于治疗痰饮阻肺证（A错）。苏子降气汤用于治疗痰浊壅肺证（D错）。麻黄汤用于治疗外感风寒证（E错）。